含有孤对电子、在体内可氧化成亚砜或砜的基团是
A. 卤素
B. 羟基
C. 硫醚
D. 酰胺基
E. 烷基

正确答案：C。硫醚

解析：本题考查药物结构中的取代基对生物活性影响。含有孤对电子、在体内可氧化成亚砜或砜的基团是硫醚（C对）。卤素（A错）属于强吸电子基，可影响电荷分布、增强脂溶性、延长药物作用时间；引入羟基（B错）可增强药物亲水性，与受体的结合力增强。酰胺（D错）可与生物大分子形成氢键，增强与受体的结合能力。